26岁，G3P2，停经8周诊断早孕，要求人流，查：子宫50天妊娠大小，右输卵管增粗，明显压痛，WBC11.6×109/L，N0.80，下列处理哪项最恰当
A. 立即行吸宫术
B. 抗炎治疗后吸宫流产
C. 抗炎治疗后刮宫流产
D. 不予人流
E. 中药堕胎

正确答案：B。抗炎治疗后吸宫流产

解析：患者输卵管增粗、压痛，WBC及N值高，考虑存在感染，需先抗感染治疗后再吸宫流产，否则易导致感染扩散。掌握“自然流产”知识点。